若行头部临时止血，可将下列哪条动脉压在第6颈椎横突上
A. 面动脉
B. 颞浅动脉
C. 上颌动脉
D. 颈总动脉
E. 颈外动脉

正确答案：D。颈总动脉

解析：当头面部大出血时，可将颈总动脉（D对）压在第6颈椎横突上，进行急救止血。